中药饮片处方的书写，一般顺序排列应当按照
A. “君、臣、佐、使”
B. “臣、君、佐、使”
C. “君、佐、臣、使”
D. “君、臣、使、佐”
E. 以上均可以

正确答案：A。“君、臣、佐、使”

解析：中药饮片处方的书写，一般应当按照“君、臣、佐、使”的顺序排列；调剂、煎煮的特殊要求注明在药品右上方，并加括号，如布包、先煎、后下等；对饮片的产地、炮制有特殊要求的，应当在药品名称之前写明。掌握“处方管理概述及一般规定、处方权”知识点。